不属于重大突发环境污染事件（Ⅱ级）的构成条件的是
A. 发生10人以上、30人以下死亡
B. 中毒（重伤）50人以上、100人以下
C. 区域生态功能部分丧失
D. 疏散转移群众1万人以上、5万人以下的
E. 4、5类放射源丢失、被盗或失控

正确答案：E。4、5类放射源丢失、被盗或失控

解析：本题考查重大突发环境污染事件（Ⅱ级）的构成条件。凡符合下列情形之一者，可定为重大突发环境污染事件（Ⅱ级）：1.发生10人以上、30人以下死亡（A对），或中毒（重伤）50人以上、100人以下（B对）；2.区域生态功能部分丧失（C对）或濒危物种生物生存环境受到污染；3.因环境污染使当地正常的经济、社会活动受到较大影响，疏散转移群众1万人以上、5万人以下的（D对）；4.1、2类放射源丢失、被盗或失控（E错，为本题正确答案）；5.因环境污染造成重要河流、湖泊、水库及沿海水域大面积污染，或县级以上城镇水源地取水中断的污染事件。